直肠上部在矢状面上的骶曲离肛门距离约
A. 15～16cm
B. 13～15cm
C. 11～13cm
D. 9～11cm
E. 7～9cm

正确答案：E。7～9cm

解析：直肠骶曲距肛门约7～9cm(E对)，会阴曲距肛门约3～5cm。